对于精神障碍患者的病理资料的保管年限是
A. 10年
B. 15年
C. 20年
D. 25年
E. 30年

正确答案：E。30年